局部振动病的诊断原则
A. 有长期从事局部振动作业的职业史
B. 有有关的主要临床表现
C. 要结合末梢循环功能及神经功能检查
D. 排除其他疾病
E. 以上都是

正确答案：E。以上都是

解析：本题考查局部振动病的诊断原则。按我国《职业性手臂振动病诊断标准》（GBZ7—2014）根据一年以上连续从事手传振动作业的职业史，以手部末梢循环障碍、手臂神经功能障碍和（或）骨关节肌肉损伤为主的临床表现，结合末梢循环功能、神经—肌电图检查结果，参考作业环境的职业卫生学资料，综合分析，排除其他病因所致类似疾病，方可诊断（E对ABCD错）。